下列关于维生素C的叙述正确的是
A. 遇酸可发生脱水反应生成脱水产物
B. 光照氧化后可生成硫色素
C. 在体内经磷酸化后生成黄素单核苷酸
D. 有吡多醇（吡多辛）、吡哆醛和吡哆胺三种形式
E. 氧化生成多聚糠醛，是该物质变色的主要原因

正确答案：E。氧化生成多聚糠醛，是该物质变色的主要原因